下列用于死胎后引产的是
A. 孕激素
B. 雌激素
C. 缩宫素
D. 催乳素
E. 米索前列醇

正确答案：E。米索前列醇

解析：引产方法有多种，包括米索前列醇，经羊膜腔注入依沙吖啶及催产素引产等。米索前列醇具有E类前列腺素的药理活性，可软化宫颈、增强子宫张力和宫内压。与米非司酮序贯应用引产目前已成为中期引产的主要方法之一，能较好的替代钳刮与羊膜腔穿刺术等手术操作，流产成功率约为96.1%，是一种安全有效的引产方法（E对）。